患者，女，45岁，6个月前因出现口吐白沫、意识丧失、二便失禁。在专科医生指导下进行抗癫痫药物治疗，症状控制良好。近3个月服用西味替丁，患者出现脱发、体重增加、肠道功能紊乱。该患者各地求医，服用各种药物，具体药物品种不详。围绕该病例，医师、药师、护士对抗癫痫药的安全用药和用药事项进行用药讨论。与该患者出现脱发，体重增加关联性较大的抗癫痫药物是
A. 地西泮
B. 卡马西平
C. 丙戊酸钠
D. 苯巴比妥
E. 苯妥英钠

正确答案：C。丙戊酸钠

解析：本题考查抗癫痫药的不良反应。丙戊酸钠（C对）主要不良反应有胃肠道功能紊乱、脱发、体重增加、肝中毒等。地西泮（A错）主要不良反应有共济失调、精神依赖性。卡马西平（B错）主要不良反应有共济失调，复视，肝损伤，骨髓抑制，皮疹，可发生抗惊厥药物过敏综合征等严重不良反应。苯巴比妥（D错）主要不良反应有镇静作用，认知障碍。苯妥英钠（E错）主要不良反应有共济失调，视物模糊，齿龈增生，镇静作用。